上颌结节阻滞麻醉容易发生的并发症
A. 血肿
B. 神经损伤
C. 暂时性面瘫
D. 恶心、呕吐
E. 牙关紧闭

正确答案：A。血肿

解析：本题考查局麻并发症-血肿。上颌结节阻滞麻醉容易发生的并发症为血肿（A对）。上颌结节阻滞麻醉，若注射针刺入过深，可能刺破上颌结节后方的翼静脉丛引起血肿。注射针刺入神经，或注入混有酒精、防腐剂的溶液，可能造成神经损伤，在任何一个阻滞麻醉的方法中都有可能出现（B错）。暂时性面瘫多见于不准确的下牙槽神经阻滞麻醉（C错）。恶心、呕吐多发生在局麻后的中毒反应（D错）。牙关紧闭多发生在下牙槽神经阻滞麻醉口内法注射后（E错）。